聚酰胺的吸附原理是
A. 相似者易于吸附
B. 相似者难于吸附
C. 离子交换吸附
D. 氢键吸附
E. 两相溶剂中的分配比不同

正确答案：D。氢键吸附